药性理论的内容主要有
A. 四气五味
B. 升降浮沉
C. 有毒无毒
D. 用药禁忌
E. 煎煮方法

正确答案：A、B、C。四气五味；升降浮沉；有毒无毒

解析：本题考查中药性能的概念。药性理论的内容主要有四气五味（A对）、升降浮沉（B对）、有毒无毒（C对）。所谓中药的性能，即中药效用的基本性质和特征的高度概括，又称药性。研究中药性能的理论，叫药性理论，包括四气、五味、升降浮沉、归经、有毒无毒等。临床使用中药时，为了确保临床疗效、安全用药，避免毒副作用的发生，必须注意中药的用药禁忌（D错）。中药的用药禁忌主要包括配伍禁忌、证候用药禁忌、妊娠禁忌和服药时的饮食禁忌四个方面。中药的用法是指中药的应用方法，其内容较为广泛，本教材主要介绍中药的给药途径、应用形式、汤剂煎煮方法（E错）和服药方法。